某男，64岁。因多饮，多食，多尿，体重减轻3年余就诊。3年来患者无明显诱因出现烦渴引饮，消谷善饥，小便频数而量多，尿液浑浊而黄，大便干燥密结，舌红，苔薄黄，脉滑数。平素嗜食肥甘厚味，长期饮酒，每日饮白酒250g，运动量少。体重从100kg下降至80kg。查空腹血糖9.0mmol/L，西医诊断为糖尿病，中医诊所为消渴病，辨证为阴虚燥热证，处方如下：中药汤剂：玉女煎加味：煅石膏30g，熟地黄20g，麦冬15g，知母10g，怀牛膝10g，天花粉15g，共5剂，水煎服，每日1剂，早、晚分服。西药：盐酸二甲双胍片500mg×20片，每次500mg，3次/日。中成药：清胃黄连丸9g×10丸，1丸/次，2次/日。执业药师审核处方时应指出玉女煎加味处方存在的问题是
A. 煅石膏应是生石膏
B. 熟地黄应是生地黄
C. 麦冬应是天冬
D. 怀牛藤应是川牛膝
E. 知母应是浙贝母

正确答案：A。煅石膏应是生石膏

解析：本题考查的是消渴的辨证论治。执业药师审核处方时应指出玉女煎加味处方存在的问题是煅石膏应是生石膏（A对）。消渴阴虚燥热证：【症状】烦渴引饮，消谷善饥，小便频数而多，尿浑而黄，形体消瘦，舌红，苔薄黄，脉滑数。【方剂应用】基础方剂为玉女煎（生石膏、熟地（B错）、麦冬（C错）、知母（E错）、牛膝（D错））加减。